AMP在体内分解时首先形成的核苷酸是
A. IMP
B. XMP
C. GMP
D. CMP
E. UMP

正确答案：A。IMP

解析：腺嘌呤核糖核苷酸（AMP）生成次黄嘌呤（IMP），次黄嘌呤在黄嘌呤氧化酶作用下氧化成黄嘌呤，最后生成尿酸。掌握“核苷酸代谢及调节”知识点。